男，55岁。突发胸痛伴大汗3小时，有吸烟史，首选的检查是
A. 胸部X线片
B. 心肌核磁显影
C. 冠状动脉CT造影
D. 心电图
E. 超声心动图

正确答案：D。心电图

解析：患者中老年男性，有吸烟史（冠心病的常见危险因素），突发胸痛伴大汗，疑诊为急性心肌梗死，此时首选的检查是心电图（D对）。心电图价格便宜，操作方便，其动态改变有助于心肌梗死的确诊。胸部X线片（P160）（A错）可显示出心脏大血管的大小、形态，对胸痛患者诊断意义不大。心肌核磁显影（B错）主要用于显示心肌缺血的范围。冠状动脉CT造影（P160）（C错）是评估冠状动脉粥样硬化的有效的无创成像方法，是筛查和诊断冠心病的重要手段，但因其价格昂贵，操作复杂，一般不作为首选检查。超声心动图（P159）（E错）可实时观察心脏和大血管结构，多用于心包积液、心肌病、先天性心脏病和各种心瓣膜病的诊断。